治疗绝经前后诸症纳少便溏者，应选取的配穴是
A. 中脘，阴陵泉
B. 关元，命门
C. 风池，太冲
D. 心俞，神门
E. 照海，阴谷

正确答案：A。中脘，阴陵泉

解析：绝经前后诸症出现纳少便溏者应配中脘、阴陵泉（A对）。关元，命门为肾阳不足型的配穴（B错）。风池，太冲为肝阳上亢型的配穴（C错）。心俞，神门为心肾不交之烦躁失眠的配穴（D错）。照海，阴谷为肾阴亏虚型的配穴（E错）。